属于高致吐风险的抗肿瘤药物是
A. 顺铂
B. 吉非替尼
C. 奥沙利铂
D. 氟尿嘧啶
E. 卡铂

正确答案：A。顺铂

解析：本题考查顺铂。属于高致吐风险的抗肿瘤药物是顺铂（A对）。化疗药致吐性按致吐频率分成四个等级水平：高度、中度、低度和微弱。①高度致吐级别：顺铂、达卡巴肼、卡莫司汀、环磷酰胺（≥1500mg/m²）、氮芥以及一些联合的化疗方案。②中度致吐级别：卡铂（E错）、环磷酰胺（＜1500mg/m²）、异环磷酰胺、多柔比星、柔红霉素、表柔比星、紫杉醇、阿糖胞苷、奥沙利铂（C错）、伊立替康、拓扑替康、培美曲塞、甲氨蝶呤（≥200mg/m²）。③低度致吐级别：依托泊苷、甲氨蝶呤（＜200mg/m²）、氟达拉滨、氟尿嘧啶（D错）、吉西他滨、多西他赛、博来霉素、长春碱、长春新碱、长春瑞滨、紫杉醇、米托蒽醌、丝裂霉素、苯丁酸氮芥等。吉非替尼（B错）为络氨酸激酶抑制剂，其常见的不良反应为皮肤毒性及腹泻，偶见间质性肺炎，皮肤不良反应包括皮疹、皮肤干燥和指甲异常，皮疹往往为痤疮样。